严重水肿可使用的药物是
A. 呋塞米
B. 氯苯蝶啶
C. 乙酰唑胺
D. 氢氯噻嗪
E. 螺内酯

正确答案：A。呋塞米

解析：本题考查呋塞米的临床作用。严重水肿可使用的药物是呋塞米（A对）。呋塞米为高效能利尿药，可治疗心、肝、肾等各类水肿。主要用于其他利尿药无效的严重水肿患者。氨苯蝶啶（B错）是留钾利尿药，在临床上用于治疗各种水肿，常与排钾利尿药合用治疗顽固性水肿。乙酰唑胺（C错）为碳酸酐酶抑制剂，临床用于治疗各种类型的青光眼及继发性青光眼降低眼压。氢氯噻嗪（D错）是中效能利尿药，可用于各种原因引起的水肿。对轻、中度心源性水肿疗效较好，是慢性心功能不全的主要治疗措施之一。螺内酯（E错）是醛固酮受体阻断剂，用于治疗与醛固酮升高有关的顽固性水肿，对肝硬化和肾病综合征水肿患者较为有效。